大量应用激素可能造成以下不良后果，除了
A. 糖尿病
B. 血压降低
C. 血钙降低
D. 念珠菌感染
E. 消化道溃疡

正确答案：B。血压降低

解析：本题考查大量应用激素可能造成的不良后果。糖皮质激素是多种口腔黏膜疾病全身治疗的首选药物。长期大量应用有较多的副作用，常见的有高血压（B错，为本题的正确答案）、糖尿病（A对）、血钙降低（C对）、念珠菌感染（D对）、消化道溃疡（E对）及低血钾等。为预防和减轻激素治疗的并发症，应定期检测血糖、血压、电解质；适当给予抗酸和胃黏膜保护剂；服用维生素AD、钙剂；给予碱性漱口液，防止念珠菌感染等。